健康者进入高原地区或通风不良的矿井可发生缺氧的主要原因在于
A. 吸入气的氧分压低
B. 肺部气体交换差
C. 肺循环血流量少
D. 血液携氧能力低
E. 组织血流量少

正确答案：A。吸入气的氧分压低

解析：健康者进入高原地区或通风不良的矿井发生的缺氧一般是乏氧性缺氧，而吸入气的氧分压低（A对）是引起乏氧性缺氧最主要的原因。肺部气体交换差（B错）可引起乏氧性缺氧，但不是健康者进入高原地区或通风不良的矿井可发生缺氧的主要原因。肺循环血流量少（C错）和组织血流量少（E错）是引起循环性缺氧的原因。血液携氧能力低（D错）引起的缺氧属于血液性缺氧。